分子中含有羟基，难以透过血脑屏障的药物是
B. 硫酸阿托品
C. 氢溴酸东莨菪碱
D. 氢溴酸山莨菪碱
E. 丁溴东莨菪碱

正确答案：D。氢溴酸山莨菪碱

解析：本题考查药物的化学结构及药理作用。分子中含有羟基，难以透过血脑屏障的药物是氢溴酸山莨菪碱（D对）。氢溴酸山莨菪碱，是一种阻断M胆碱受体的抗胆碱药，具有松弛平滑肌、解除血管痉挛、改善微循环、镇痛的作用，分子中含有6-羟基增加了药物的极性，使其难于透过血脑屏障。氢溴酸后马托品（A错）、硫酸阿托品（B错）、氢溴酸东莨菪碱（C错）、丁溴东莨菪碱（E错）都是抗胆碱药，分子中含有非6-羟基，易透过血脑屏障。